家庭常用的洗涤剂产生危害的主要因素是
A. 助洗剂
B. 络合剂
C. 腐蚀抑制剂
D. 表面活性剂
E. 沉淀剂

正确答案：D。表面活性剂

解析：本题考查家庭常用的洗涤剂产生危害的主要因素。表面活性剂具有亲水、亲油特性，可将污垢润湿、渗透，并借助于搓捏刷洗使污垢乳化、扩散至洗涤剂溶液中，从而达到去污目的。可分为阳离子型、阴离子型、非离子型和两性型4类，家庭常用的主要是阴离子型和非离子型洗涤剂。表面活性剂（D对ABCE错）是家庭常用的洗涤剂产生危害的主要因素。